氯霉素有作用的是
A. 结核分枝杆菌
B. 真菌
C. 衣原体
D. 原虫
E. 病毒

正确答案：C。衣原体

解析：氯霉素对立克次体、衣原体（C对）、支原体也有抑制作用。对结核分枝杆菌（A错）、真菌（B错）、原虫（D错）和病毒（E错）无效。